经肾失钾过多的原因是
A. 速尿、利尿酸的使用
B. 肾小管性酸中毒
C. 盐皮质激素过多
D. 镁缺失
E. 以上都是

正确答案：E。以上都是

解析：速尿、利尿酸的使用（A对）使肾排钾增多。肾小管性酸中毒（B对）时由于远曲小管泌H＋障碍，导致Na⁺-K⁺交换增加，尿钾排出增多。醛固酮（C对）可作用于远曲小管、集合管，使肾保钠排钾作用加强。镁缺乏（D对，故E为本题正确答案）使Na⁺-K⁺-ATP酶活性降低，导致肾保钾功能减退。